关于香精油的下列描述中，不正确的是
A. 主要为麝香草酚、薄荷醇和甲基水杨酸盐混合而成
B. 主要用作漱口剂
C. 能清除菌斑中的内毒素
D. 又称酚类化合物
E. 可提高菌斑的毒性

正确答案：E。可提高菌斑的毒性

解析：酚类化合物又称香精油主要为麝香草酚、薄荷醇和甲基水杨酸盐混合而成的抗菌斑制剂，主要用作漱口剂，每天2次，短期研究效果可减少菌斑量及降低龈炎指数平均35%。由于它能清除菌斑中的内毒素，因此可明显降低菌斑的毒性。掌握“菌斑控制及提高宿主抵抗力”知识点。